代谢性酸中毒时过度通气可产生
A. 水肿
B. 水中毒
C. 低渗性脱水
D. 等渗性脱水
E. 高渗性脱水

正确答案：E。高渗性脱水

解析：过度通气时呼吸道黏膜不感性蒸发加强，机体水分丧失而无电解质的丢失，细胞外液渗透压增高，出现高渗性脱水（E对）。水肿（A错）为过多的液体在组织间隙或体腔内积聚，水中毒（B错）时患者水潴留使体液增多，低渗性脱水（C错）为机体失钠大于失水，等渗性脱水（D错）特点为水钠成比例丢失。